根据卫生部等九部委局《关于建立国家基本药物制度的实施意见》，非政府举办的各类医疗机构应当
A. 按30%选择配备和使用国家基本药物
B. 按50%选择配备和使用国家基本药物
C. 按100%选择配备和使用国家基本药物
D. 首选基本药物并达到一定使用比例
E. 按80%选择配备和使用国家基本药物

正确答案：D。首选基本药物并达到一定使用比例

解析：本题考查的是《关于建立国家基本药物制度的实施意见》。根据卫生部等九部委局《关于建立国家基本药物制度的实施意见》，非政府举办的各类医疗机构应当首选基本药物并达到一定使用比例（D对）。《关于建立国家基本药物制度的实施意见》第十三条规定，建立基本药物优先和合理使用制度。政府举办的基层医疗卫生机构全部配备和使用国家基本药物（C错）。在建立国家基本药物制度的初期，政府举办的基层医疗卫生机构确需配备、使用非目录药品，暂由省级人民政府统一确定，并报国家基本药物工作委员会备案。配备使用的非目录药品执行国家基本药物制度相关政策和规定。其他各类医疗机构也要将基本药物作为首选药物并达到一定使用比例，具体使用比例由卫生行政部门确定。